牙隐裂可伴症状
A. 温度刺激痛
B. 咬物痛
C. 自发痛
D. 无明显症状
E. 以上都可能

正确答案：E。以上都可能

解析：本题考查牙隐裂的症状。牙隐裂是指发生在牙冠表面的细小、不易发现的、非生理性的细小裂纹。早期病变局限在牙釉质没有明显症状（D对）。遭受外力后裂纹加深，累及牙本质，部分牙本质小管暴露，出现牙本质敏感症状，细菌顺裂缝进入牙髓，引起牙髓发生炎症，出现温度刺激痛（A对）、自发痛（C对）等牙髓炎症状。当病变继续发展，牙髓炎发展到根尖周炎会出现咬合痛（B对）。（ABCD均对，故E为本题的正确答案）。